酸枣仁除养心安神外,还具有的功效是
A. 平喘
B. 通便
C. 敛汗
D. 消食
E. 利尿

正确答案：C。敛汗

解析：酸枣仁的功效是养心益肝，安神，敛汗，生津（C对）。